一对年轻夫妇计划出国旅游，出发前，准备选购以下治疗腹泻的药物备用，包括蒙脱石、口服补液盐、双歧杆菌三联活菌、洛哌丁胺，小檗碱。执业药师不推荐它们购买双歧杆菌三联活菌制剂，建议更换为地衣芽孢杆菌活菌制剂，最可能的原因是
A. 疗效不确切
B. 需冷藏保存，携带不便
C. 不良反应较多
D. 不适合成年人服用
E. 服用不方便

正确答案：B。需冷藏保存，携带不便

解析：本题考查双歧杆菌三联活菌制剂。双歧杆菌三联活菌制剂需冷藏保存，携带不便（B对）。地衣芽孢杆菌活菌为活菌制剂，但无需冷藏，室温贮藏即可，溶解时水温不宜超过40℃。